金属烤瓷全冠舌侧颈缘如以金属为冠边缘者，可预备成以下形状，除了
A. 羽状
B. 凹槽形
C. 较宽的肩台
D. 直角斜面形
E. 与金属全冠边缘相同

正确答案：C。较宽的肩台

解析：本题考查以金属为冠边缘的金属烤瓷全冠舌侧颈缘的肩台设计。牙体预备时，应尽可能保存、保护牙体、牙髓组织健康，争取保留足够的牙体组织，减少患牙破坏，获得修复体远期疗效，所以金属边缘不必预备成较宽的肩台（C错，为本题的本题正确答案），造成牙体磨除量过多。刃状肩台、羽状肩台（A对）、凹槽型肩台（B对）、直角斜面形肩台（D对）带斜面的肩台形边缘形式适合修复材料强度大的金属修复体，也可预备成与金属全冠边缘相同的肩台（E对），这些形状都可保证金属边缘足够的强度。